女，60岁。被家人发现昏迷在浴室内，浴室使用燃气热水器。查体：皮肤潮红，瞳孔大小正常，口唇樱桃红色。最有可能的诊断是
A. 阿托品中毒
B. 一氧化碳中毒
C. 乙醇中毒
D. 有机磷杀虫药中毒
E. 镇静催眠药中毒

正确答案：B。一氧化碳中毒

解析：患者老年女性，昏迷在使用燃气热水器的浴室内（日常生活中一氧化碳中毒的常见原因），查体：皮肤潮红，瞳孔大小正常，口唇樱桃红色（一氧化碳中毒的特征性临床表现），其最可能的诊断是一氧化碳中毒（B对）。阿托品中毒（A错）常表现为面红、口干、皮肤干燥、心跳加快，瞳孔散大等症状；乙醇中毒（P900）（C错）昏迷期表现为昏睡、瞳孔散大、体温降低；有机磷杀虫药中毒（P884）（D错）会出现M样症状（包括瞳孔缩小、大小便失禁、大汗、流泪、呼吸困难等）和（或）N样症状（包括肌纤维颤动、全身肌强直性痉挛等）；镇静催眠药中毒（E错）常表现为嗜睡、神志恍惚甚至昏迷、言语不清、瞳孔缩小、皮肤湿冷、脉搏细速、发绀、尿少等症状，后四种情况均有相应的毒物接触史，且不会出现口唇樱桃红色的表现。